小儿生长发育的规律正确的是
A. 生长发育没有一定的规律
B. 各系统发育的速度不一致
C. 生长发育是量先增加后有质的变化
D. 小儿体格的发育青春期最快
E. 体格发育有绝对的正常值

正确答案：B。各系统发育的速度不一致

解析：小儿各系统发育的速度并不一致（B对），生长发育是非匀速性和阶段性统一的过程。这个过程遵循一定的总规律发展（A错）：即从上到下，由近到远、由粗到细、由低级到高级、由简单到复杂的规律。并在一定的正常范围内受遗传、环境的影响，存在着相当大的个体差异，但没有绝对的正常值（E错）。生长发育是机体质变和量变相统一的过程，两者不分先后顺序（C错）。婴儿期和青春期是生长发育过程中的两个高峰期，其中婴儿期的速度最快（D错）。